主要用于治疗室上性和房室结折返引起的心律失常，为阵发性室上性心动过速首选药的是
A. 维拉帕米
B. 肾上腺素
C. 硝苯地平
D. 阿托品
E. 尼莫地平

正确答案：A。维拉帕米

解析：主要用于治疗室上性和房室结折返引起的心律失常，为阵发性室上性心动过速首选药。掌握“钙通道阻滞药分类及代表药物”知识点。